女，23岁。跟邻居吵架时突发剧烈头痛、呕吐、视物双影2小时。平时偶有一侧头痛，严重时伴畏光、恶心、呕吐。查体：右眼睑下垂，右瞳孔散大，对光反射消失，右眼向上、下、内活动受限，颈强直（+）。急诊首选的辅助检查是
A. 头颅MRI
B. DSA
C. 经颅多普勒超声
D. 腰椎穿刺
E. 头颅CT

正确答案：E。头颅CT

解析：青年患者，既往有头痛史，严重时伴畏光、恶心、呕吐，情绪激动后突发剧烈头痛、呕吐、视物双影2小时，查体：右眼睑下垂，右瞳孔散大，对光反射消失，右眼向上、下、内活动受限（提示动眼神经受压），颈强直（+）（脑膜刺激征阳性），根据患者的病史、临床症状及体征，考虑最可能的诊断为颅内动脉瘤破裂导致的蛛网膜下腔出血，急诊首选的辅助检查是头颅CT（E对），该检查出血早期敏感性高，可检出90%以上的蛛网膜下腔出血。头颅MRI（A错）在数天CT检查的敏感性降低时，可发挥较大作用。DSA（B错）是确诊的金标准， 可明确动脉瘤的大小、位置、与载瘤动脉的关系，但不是急诊首选方法。 腰椎穿剌（D错）如果CT扫描结果阴性，强烈建议行腰穿CSF检查。经颅多普勒超声（C错）对该病的诊断意义不大。